浅Ⅱ度烧伤的创面表现是
A. 剧痛，局部红肿，有水疱
B. 疼痛，创面发红，无水疱
C. 无痛，创面苍白，有水疱
D. 无痛，创面苍白，无水疱
E. 无痛，创面蜡白，无弹性

正确答案：A。剧痛，局部红肿，有水疱